内痔好发于
A. 612点处
B. 39点前面
C. 肛门齿线以上3/7/11点处
D. 612点外
E. 肛缘39点处

正确答案：C。肛门齿线以上3/7/11点处

解析：因肛门直肠疾病的发病部位有一定的规律，通过辨别疾病发生的部位，可以大致确定疾病种类及性质，为进一步治疗创造条件。一般取膀胱截石位，以肛门为中心，按时钟面的12个点来描记、即将肛门分为12个方位，前正中线（会阴部）为12点，后正中线（骶尾部）为6点，左侧正中为3点，右侧正中为9点，其余依次类推。内痔好发于肛门齿线以上3、7、11点处（C对）。肛裂好发于6、12点（A错）。肛瘘瘘管外口好发于3、9点前面（B错）。环肛而生的马蹄形瘘，其内口往往在6、12点处附近（D错）。血栓性外痔好发于肛缘3、9点（E错）。